小儿应用脉诊的最早年龄是
A. 1周岁
B. 2周岁
C. 3周岁
D. 4周岁
E. 7周岁

正确答案：C。3周岁

解析：小儿脉诊与成人脉诊不同，3岁以下小儿由于其手臂短，难分三部，加之诊病时小儿多有哭闹，影响脉象的真实性，故一般以察指纹诊法代替切脉。3岁以上小儿用"一指定三关"的方法诊脉，也称作"寸口一指脉"，即一般以一指正按定关脉，向前辗定寸脉，向后辗定尺脉（C对）。